功能息风止痉的药物是
A. 麝香
B. 冰片
C. 两者均是
D. 两者均不是

正确答案：D。两者均不是

解析：本题考查的是麝香与冰片的功效。麝香与冰片均无息风止痉功效（D对）。麝香（A错）：【功效】开窍醒神，活血通经，消肿止痛。冰片（B错）：【功效】开窍醒神，清热止痛。息风止痉为僵蚕的功效。僵蚕：【功效】息风止痉，祛风止痛，化痰散结。